抗结核联合治疗方案中，可引起球后视神经炎不良反应的药物是
A. 左氧氟沙星
B. 乙胺丁醇
C. 利福平
D. 吡嗪酰胺
E. 链霉素

正确答案：B。乙胺丁醇

解析：本题考查药物的不良反应。抗结核联合治疗方案中，可引起球后视神经炎不良反应的药物是乙胺丁醇（B对）。乙胺丁醇主要不良反应为球后视神经炎，表现为弱视、红绿色盲和视野缩小。少数患者可出现皮疹、药热等过敏反应。左氧氟沙星（A错）属于喹诺酮类抗菌药物，不良反应有消化系统反应，肝毒性，血液系统毒性和软骨系统毒性等。利福平（C错）的不良反应有肝损害、消化道反应、过敏反应、流感样综合征、致畸作用等。吡嗪酰胺（D错）长期大量使用可引起肝损害，表现为氨基转移酶升高、黄疸、肝细胞坏死等。本品也可引起高尿酸血症、胃肠道反应、过敏反应等。链霉素（E错）单用易产生耐药性，长期应用发生耳毒性。